流行病学现场试验中实验组和对照组人群最大的不同点是
A. 观察指标不同
B. 目标人群不同
C. 入选标准不同
D. 干预措施不同

正确答案：D。干预措施不同

解析：本题考查临床试验中实验组和对照组的差别。临床试验的对照组和实验组一样，均为患病的病人。两者的不同之处在于对照组和实验组的处理因素不同，实验组会接受某种处理因素，而对照组不会接受该种处理因素（D对ABC错），其它基线信息尽可能保持一致，以增加可比性。